某男，75岁，数月来心悸健忘，失眠多梦，大便干燥。证属心阴不足，宜选用的成药是
A. 生脉胶囊
B. 八珍颗粒
C. 柏子养心丸
D. 天王补心丸
E. 人参归脾丸

正确答案：D。天王补心丸

解析：本题考查的是天王补心丸的主治。数月来心悸健忘，失眠多梦，大便干燥。证属心阴不足，宜选用的成药是天王补心丸（D对）。天王补心丸：【主治】心阴不足，心悸健忘，失眠多梦，大便干燥。生脉胶囊（A错）：【主治】气阴两亏，心悸气短，脉微自汗。八珍颗粒（B错）：【主治】气血两虚，面色萎黄，食欲不振，四肢乏力，月经过多。柏子养心丸（C错）：【主治】心气虚寒，心悸易惊，失眠多梦，健忘。人参归脾丸（E错）：【主治】心脾两虚、气血不足所致的心悸、怔忡、失眠健忘、食少体倦、面色萎黄，以及脾不统血所致的便血、崩漏、带下。